某女，24岁，左乳房内单个肿块，不痛，边界清楚，表面光滑，活动度好，应诊断为
A. 乳核
B. 乳腺增生
C. 乳疠
D. 乳痈
E. 乳岩

正确答案：A。乳核

解析：患者左乳房内单个肿块，不痛，边界清楚，表面光滑，活动度好，符合乳核的临床特点，故应诊断为乳核（A对）。乳腺增生，相当于中医学中的乳癖，其临床特点是单侧或双侧乳房疼痛并出现肿块，乳痛和肿块与月经周期及情志变化密切相关。乳房肿块大小不等，形态不一，边界不清，质地不硬，活动度好（B错）。乳疠是指指男女儿童或中老年男性在乳晕部出现的疼痛性结块，其临床特点是乳晕中央有扁圆形肿块，质地中等，有轻压痛（C错）。乳痈是发生在乳房部的最常见的急性化脓性疾病，其临床特点是乳房结块，红肿热痛，溃后脓出稠厚，伴恶寒发热等全身症状（D错）。乳岩多发于40～60 岁妇女，乳房肿块质地坚硬如石，表面高低不平，边界不清，活动度差，常与皮肤及周围组织粘连，皮肤可呈橘皮样改变，患侧淋巴结可肿大（E错）。